为了验证社会预防措施的效果常采用以下哪种研究方法
A. 分析性研究
B. 实验性研究
C. 理论研究
D. 综合评价
E. 描述性研究

正确答案：B。实验性研究

解析：本题考查验证社会预防措施的效果常采用的研究方法。实验性研究（B对ACDE错）是以社区人群作为实验研究的对象，常用于考察卫生服务和疾病防治的效果。